女，50岁。腹痛、腹胀5天，伴呕吐1天。腹痛、腹胀逐渐加重，呕吐物为隔夜酸酵食物，无呕血，未排大便，未排气，小便量减少。既往十二指肠球部溃疡病多年，近2个月来进食后上腹胀满感。查体：T37.2℃，P80次/分。消瘦，皮肤黏膜干燥。上腹膨隆，可见胃型，有振水音，无肌紧张、反跳痛。除抗酸、解痉外，首选的治疗方案是
A. 急诊行选择性迷走神经切断+幽门成形术
B. 胃肠减压，温盐水洗胃
C. 急诊行胃大部切除术
D. 促进胃肠动力药物治疗
E. 肠外营养支持

正确答案：B。胃肠减压，温盐水洗胃

解析：患者十二指肠球部溃疡病史（病因），腹痛、腹胀，呕吐物为隔夜酸酵食物，未排便排气，上腹膨隆，可见胃型，有振水音，皮肤黏膜干燥。考虑诊断为幽门梗阻。除抗酸、解痉外，首选的治疗方案是胃肠减压，温盐水洗胃（B对），以减轻胃壁水肿。同时补充液体、电解质，维持酸碱平衡和营养（E错）。如保守治疗症状未能缓解，可考虑手术治疗（C错）。术前需进行准备，全身情况如脱水、贫血需要纠正。胃壁水肿需要改善。手术目的是解除梗阻、消除病因，因此首选胃大部切除术。